外感风热病人，可见的症状是
A. 鼻腔干燥
B. 鼻塞流浊涕
C. 鼻流浊涕腥臭
D. 鼻血鲜红
E. 鼻塞流清涕

正确答案：B。鼻塞流浊涕

解析：新病流涕多属外感表证，鼻塞流浊涕，属风热表证（B对）。鼻腔干燥（A错），为感受燥邪。久流浊涕，质稠、量多、气腥臭者（C错），为鼻渊，多因外感风热或湿热蕴阻所致。鼻血鲜红（D错），为外伤或感受燥邪。新病流涕多属外感表证，鼻塞流清涕（E错），属风寒表证。